阿托品可引起
A. 诱发、加重青光眼
B. 易发生低血糖反应
C. 诱发哮喘、加重心衰
D. 导致出大汗、发生虚脱
E. 导致脱水、低血钾、电解质紊乱

正确答案：A。诱发、加重青光眼

解析：本题考查阿托品的不良反应。阿托品可诱发、加重青光眼（A对）。阿托品为M胆碱受体阻断剂，可扩大瞳孔升高眼内压，容易引起青光眼急性发作。